某糖尿病患者为了控制血糖，在医生建议下准备和营养师一起制定一份饮食计划，她虽然知道控制饮食的好处，但总认为无法管住自己，计划难以实施，对这样的患者，医生干预的重点是
A. 提高自我效能
B. 培养行为能力
C. 提高结果预期
D. 提供社会支持
E. 建立支持性环境

正确答案：A。提高自我效能

解析：自我效能指一个人对自己实施或放弃某一行为的能力的自信，相信自己一定能通过努力成功地采取一个导致期望结果的行动｡题干中患者存在的主要问题为在没有采取行动前，认为无法管住自己，害怕计划难以实施，需要提高自我效能(A对）来增加对行动和计划实施的自信｡